位于中脑的核团是
A. 蓝斑
B. 泌涎核
C. 孤束核
D. 齿状核
E. 动眼神经核

正确答案：E。动眼神经核

解析：动眼神经核（E对）位于中脑导水管周围灰质的腹内侧；蓝斑（A错）位于界沟上端的外侧；泌涎核（B错）分上泌涎核和下泌涎核，前者位于脑桥，后者位于延髓；孤束核（C错）位于延髓内界沟外侧；齿状核（D错）位于小脑半球的白质内。